使用电刀切龈时严禁触及牙面和根面，原因
A. 可造成组织缺损
B. 可造成骨坏死
C. 可造成软组织坏死
D. 可刺激牙髓造成牙髓病变
E. 可引起牙槽骨坏死

正确答案：D。可刺激牙髓造成牙髓病变

解析：本题考查使用电刀切龈时严禁触及牙面和根面的原因。若电刀切龈时触及了牙面和根面，电流会通过牙釉质间隙、牙本质小管传入牙髓，可刺激牙髓造成牙髓病变（D对）。电刀用来切割软组织，对硬组织几乎无作用，若触牙根、牙面等硬组织时一般不会造成组织缺损（A错）、骨坏死（B错）、牙槽骨坏死（E错）。使用电刀切割牙龈只要控制电流量和切割频率，一般不会引起软组织坏死（C错），严禁触及牙面和根面与可造成软组织坏死无关。